主治壮热面赤，汗出恶热的首选方剂是
A. 竹叶石膏汤
B. 犀角地黄汤
C. 黄连解毒汤
D. 白虎汤
E. 清营汤

正确答案：D。白虎汤

解析：本题主要考查方剂的功效主治。白虎汤具有清热生津的功效，主治气分热盛证。壮热面赤，烦渴引饮，汗出恶热（D对）。竹叶石膏汤具有清热生津，益气和胃的功效，主治伤寒、温病、暑病余热未清，气津两伤证。身热多汗，心胸烦闷，气逆欲呕， 口干喜饮，气短神疲，或虚烦不寐，舌红苔少，脉虚数（A错）。犀角地黄汤主治热入血分证，热扰心神，身热谵语；热伤血络，斑色紫黑、吐血、衄血、便血等；蓄血瘀热，喜忘如狂，漱水不欲咽，大便色黑易解等（B错）。黄连解毒汤主治三焦火毒证。大热烦躁，口燥咽干，错语不眠；或热病吐血、衄血；或热甚发斑；或身热下利，或湿热黄疸；或外科痈疡疔毒（C错）。清营汤主治热入营分证。身热夜甚，神烦少寐，时有谵语，目常喜开或喜闭，口渴或不 渴，斑疹隐隐，脉细薮，舌绛而干（E错）。